金元以前哮与喘混称，明以后首先提出哮与喘当为二个不同病证的医著是
A. 《景岳全书》
B. 《临证指南》
C. 《医学正传》
D. 《医学心悟》
E. 《医学入门》

正确答案：C。《医学正传》

解析：《景岳全书》说：“实喘者有邪，邪气实也；虚喘者无邪，元气虚也。”指出喘证的辩证纲领（A错）。《临证指南医案·喘》：“在肺为实，在肾为虚”（B错）。《医学正传》对哮与喘作了明确的区别（C对）。《医学心悟·喘》：“夫外感之喘，多出于肺；内伤之喘，未有不由于肾者”（D错）。《医学入门》论四饮，未提及哮与喘的区别（E错）。